药品监督管理部门在日常监督检查工作中，发现甲药品零售企业在柜台销售标示乙医院配制的治疗痤疮的外用膏剂。经立案调查，查实乙医院具有《医疗机构制剂许可证》，但在未取得制剂批准文号情况下，由医院制剂部门擅自配制，后经乙医院药剂人员丙购买并出售给甲药品零售企业。甲药品零售企业所持的《药品经营许可证》的经营范围包括化学药制剂、中成药。经抽验，该外用膏剂相应检验项目符合制剂标准规定。根据上述信息，乙院配制的外用膏剂应定性为
A. 按假药论处的药品
B. 合法药品
C. 需要重新补办批准文号的不能定性的药品
D. 只能在乙医院调剂使用的医疗机构制剂

正确答案：A。按假药论处的药品

解析：本题考查按假药论处的情形。获得《医疗机构制剂许可证》的医疗机构，如果需要进行某种制剂的配制，应当向所在地省（区、市）药品监督管理部门申请，并报送有关资料和样品，经所在地省（区、市）药品监督管理部门批准，发给制剂批准文号后，方可配制。根据《药品管理法》的规定：有下列情形之一的药品，按假药论处：①国务院药品监督管理部门规定禁止使用的；②依照本法必须批准而未经批准生产、进口，或者依照本法必须检验而未经检验即销售的；③变质的；④被污染的；⑤使用依照本法必须取得批准文号而未取得批准文号的原料药生产的；⑥所标明的适应症或者功能主治超出规定范围的。因此乙医院配制的外用膏剂应定性为按假药论处的药品（A对）。